妇科十味片具有养血舒肝、调经止痛的功能。处方组成：醋香附500g、川芎20g、当归180g、醋延胡索40g、白术29g、甘草14g、大枣100g、白芍15g、赤芍15g、熟地黄60g、碳酸钙65g。以上十一味，当归126g、醋香附、醋延胡索、白芍、赤芍、碳酸钙粉碎成细粉，甘草、大枣加水煎煮三次，合并煎液，滤过；剩余当归与白术、熟地黄、川芎用70%乙醇加热回流二次，滤过，合并二次滤液，回收乙醇。将以上两种滤液合并，减压浓缩为稠膏，加入上述醋香附等六味细粉，混匀，干燥，粉碎成细粉，用糖浆与淀粉糊制成颗粒，干燥压制成3000片，包薄膜衣，即得。处方中醋延胡索所含延胡索乙素的化学结构类型是
A. 双稠哌类生物碱
B. 苄基异喹啉类生物碱
C. 吡啶类生物碱
D. 吲哚类生物碱
E. 吗啡烷类生物碱

正确答案：B。苄基异喹啉类生物碱

解析：本题考查生物碱的分类及结构特征。延胡索乙素的结构类型为异喹啉类生物碱（B对）。生物碱可按植物来源、生源途径和基本母核的结构类型等分类，目前较新的分类方法是按生源途径结合化学结构类型分类。生物碱的种类繁多，结构复杂，主要要求掌握以下五种基本母核类型生物碱的结构特征：吡啶类生物碱、莨菪烷类生物碱、异喹啉类生物碱、吲哚类生物碱、有机胺类生物碱。异喹啉类生物碱：这类生物碱来源于苯丙氨酸和酪氨酸系，具有异喹啉或四氢异喹啉的基本母核，在植物中分布广泛，数目较多，具有多方面的生物活性。根据其基本结构又分为多种类型，主要类型如简单异喹啉类、苄基异喹啉类、原小檗碱类、吗啡烷类。原小檗碱类：此类生物碱可以看成由两个异喹啉环稠合而成，依据两者结构母核中D环氧化程度不同，又分为小檗碱类和原小檗碱类。前者多为季铵碱，如黄连、黄柏、三颗针中的小檗碱；后者多为叔胺碱，如延胡索中的延胡索乙素。吗啡烷类（E错）：这类化合物具有部分饱和的菲核，如罂粟中的吗啡、可待因，青风藤中的青风藤碱等。吡啶类生物碱（C错）：此类生物碱多来源于赖氨酸，是由吡啶或哌啶衍生的生物碱，其结构简单，数量较少，主要有两种类型为简单吡啶类和双稠哌啶类（A错）。吲哚类生物碱（D错）：这类生物碱来源于色氨酸，其数目较多，结构复杂，多具有显著的生物活性。主要分布于马钱科、夹竹桃科、茜草科等。吲哚类生物碱主要由色氨酸衍生而成，根据其结构特点，主要分为以下四类简单吲哚类、色胺吲哚类、单萜吲哚类、双吲哚类。